反映血浆中HCO₃⁻实际含量的指标是
A. SB
B. BB
C. BE
D. AB
E. AG

正确答案：D。AB

解析：反映血浆中HCO₃⁻实际含量的指标是AB（D对），该指标是指在实际PaCO₂、体温和血氧饱和度条件下测得的血浆HCO₃⁻浓度。